哺乳期妇女避孕应在产后
A. 6周
B. 12周
C. 18周
D. 24周
E. 30周

正确答案：A。6周

解析：从胎盘娩出至产后6周，称为产褥期。产褥期内禁忌性交。产后6周（2版八年制妇产科学P431）（A对）起应采取避孕措施。